体现入营犹可透热转气的药对是
A. 犀角、竹叶
B. 银花、连翘
C. 犀角、生地
D. 丹皮、赤芍
E. 丹皮、生地

正确答案：B。银花、连翘

解析：清营汤治热传营，脉数舌绛辨分明，犀地银翘玄连竹，丹麦清热更护阴。清营汤的功用为清营解毒，透热养阴，主治热入营分证。温邪初入营分，用银花、连翘清热解毒，轻清透泄，使营分热邪有外达之机，促其透出气分而解，体现了入营犹可透热转气（B对）。